止嗽散的组成药物中含有
A. 青皮
B. 木香
C. 香附
D. 厚朴
E. 陈皮

正确答案：E。陈皮

解析：止嗽散功能宣利肺气，疏风止咳，由桔梗、荆芥、紫菀、百部、甘草、陈皮组成（E对）。记忆：止嗽散中有荆桔，百部紫菀草陈前。